经高压蒸汽灭菌的物品一般可保留
A. 5天
B. 7天
C. 10天
D. 14天
E. 21天

正确答案：D。14天

解析：通过高压蒸气灭菌法灭菌的物品有效期通常为两周，即经高压蒸气灭菌的物品一般可保留14天（D对）。